—位服用了60多片安定的精神病患者被送到医院急救，患者父母表示无力承担抢救费用。按照急救伦理的要求，医生应该选择的处理措施是
A. 在征得患者父母同意和医院领导同意的情况下，迅速实施抢救
B. 在征得患者父母同意的情况下，放弃治疗
C. 放弃治疗，让患者父母将其接回家
D. 向民政部门反映，争取社会支持，并由他们决定是否抢救
E. 仅给予患者家庭能够承受费用的支持疗法

正确答案：A。在征得患者父母同意和医院领导同意的情况下，迅速实施抢救

解析：按照急救伦理的要求，即使病人无经济能力支付医药费，也不能延误了抢救时机，放弃治疗，那是是对生命的亵渎，是遭人唾弃的不道德行为；而应分秒必争，全力以赴，迅速实施抢救（A对）。